下列检查，对鉴别慢性菌痢与直肠癌最简便而有意义是
A. 直肠镜
B. 大便潜血
C. X线钡灌肠
D. 直肠肛门指诊
E. 大便常规

正确答案：D。直肠肛门指诊

解析：慢性菌痢中年以后发病率较高，病情顽固，抗菌剂疗效不佳，全身状况差并且呈进行性。一般来讲，对慢性患者，均应尽早肛检或内窥镜检。直肠癌的最主要和最直接的方法是直肠肛门指诊，通过检查可初步了解癌肿与肛缘的距离、大小、硬度、形态及其与周围组织的关系（D对）。